女26岁，右上后牙龈肿痛1周，口服消炎药治疗无效。检查：右上6颊侧牙周脓肿形成，叩（+），冷测敏感，牙周袋8mm，应急处理应是
A. 局麻下开髓
B. 龈上洁治
C. 龈下刮治
D. 脓肿切开引流
E. 药物治疗

正确答案：D。脓肿切开引流

解析：本题考查急性牙周脓肿的治疗原则。牙周脓肿是牙周炎发展到晚期，出现深牙周袋后的一个较常见的伴发症状，急性牙周脓肿发病突然，在患牙的唇颊侧或舌腭侧牙龈形成椭圆形或半球形的肿胀突起，结合患者的检查结果和症状，可判断患者出现的是急性牙周脓肿的症状。在脓肿初期脓液尚未形成前，可轻轻清除大块牙石，冲洗牙周袋，将防腐抗菌药物引入袋内，必要时全身给以抗生素或支持疗法；当脓液形成且局限、出现波动时，患者感极端疼痛，切开引流后能缓解肿痛感，可根据脓肿的部位及表面黏膜的厚薄，选择从牙周袋内或牙龈表面进行脓肿切开引流（D对），切开后应彻底冲洗脓腔，或在局麻下彻底进行龈下清创术。局麻下开髓（A错）、龈上洁治（B错）、龈下刮治（C错）、药物治疗（E错）是对急性牙周脓肿在脓肿切开引流后进行的处理措施，非应急处理。